女，78岁。跌倒时左肩部着地受伤。既往脑梗死病史8年，遗留左侧肢体偏瘫。查体：左肩部肿痛，活动受限。X线片检查示左肱骨大结节与肱骨干交界处可见多个骨碎块，对线尚可，略有侧方移位。首选治疗方法是
A. 尺骨鹰嘴外展位骨牵引
B. 手法复位，外固定
C. 切开复位内固定
D. 小夹板固定、皮牵引
E. 三角巾悬吊对症治疗

正确答案：E。三角巾悬吊对症治疗

解析：老年女性，左肩部外伤，X线片示左肱骨大结节与肱骨干交界处多个骨碎块，应诊断为左侧肱骨外科颈粉碎性骨折，属Neer二型（P633）。患者年龄较大，对线尚可，既往有脑梗死病史，一般情况较差，因此对于功能要求不高，可使用三角巾悬吊（E对）3～4周，任其自然愈合。尺骨鹰嘴外展位骨牵引（A错）多用于肱骨髁上骨折。老年人发生的肱骨解剖颈或外科颈的二部分骨折，不必进行复位及制动，以免造成关节僵硬（七版黄家驷外科学P2775），因此不宜采用手法复位、外固定（B错）或切开复位内固定（C错）的方案。小夹板固定适用于四肢闭合性、无移位、稳定性骨折，皮牵引多适用于颈椎骨折脱位、股骨和胫骨骨折（D错）。